宜用中火炒制的饮片是
A. 炒苍耳子
B. 炒牛蒡子
C. 炒栀子
D. 炒芥子
E. 炒莱菔子

正确答案：A。炒苍耳子

解析：本题考查的是苍耳子的炮制方法。宜用中火炒制的饮片是炒苍耳子（A对）。苍耳子：【炮制方法】处方用名有苍耳子、炒苍耳子。①苍耳子：取原药材，除去杂质，用时捣碎。②炒苍耳子：取净苍耳子，置炒制容器内，用中火加热，炒至黄褐色，刺焦时即可，碾去刺，筛净。用时捣碎。炒牛蒡子（B错）：取净牛蒡子，置炒制容器内，用文火加热，炒至略鼓起，微有香气，断面浅色时，取出。用时捣碎。炒栀子（C错）：取栀子碎块，置炒制容器内，用文火加热，炒至深黄色，取出晾凉。 炒芥子（D错）：取净芥子，置炒制容器内，用文火加热，炒至淡黄色至深黄色（炒白芥子）或深黄色至棕褐色（炒黄芥子），有爆鸣声，断面浅黄色，有香辣气时即可。用时捣碎。炒莱菔子（E错）：取净莱菔子，置炒制容器内，用文火加热，炒至微鼓起，质酥脆，断面浅黄色，有香气逸出即可。用时捣碎。